初孕妇，30岁。妊娠38周，因胸闷、憋气、不能平卧3日后入院。检查：血压120/80mmHg，脉搏110次/min，呼吸22次/min。心尖部闻及3/6级收缩期杂音。半卧位时颈静脉轻度怒张，双肺底闻及湿啰音。为明确诊断，首先应选择的辅助检查是
A. 血常规
B. 查尿蛋白
C. 肝肾功能
D. 超声心动检查
E. 胸部X线片

正确答案：D。超声心动检查